某病的病死率指的是
A. 在所有死因中某病的病的比例
B. 患某病的病人中因该病而死亡者的比值
C. 每十万人口的粗死亡率
D. 特殊原因引起的某病死亡率

正确答案：B。患某病的病人中因该病而死亡者的比值

解析：本题考查病死率的概念。病死率表示一定时期内因某病死亡者占该病病人的比例（B对ACD错），表示某病病人因该病死亡的危险性。